患者，女，27岁，孕34周。诊断为轻度便秘，宜选用的药物是
A. 蓖麻油
B. 乳果糖
C. 硫酸镁
D. 普芦卡必利
E. 利那洛肽

正确答案：B。乳果糖

解析：本题考查乳果糖。诊断为轻度便秘，宜选用的药物是乳果糖（B对）。乳果糖是一种渗透性泻药，可用于妊娠期和哺乳期妇女，安全性好、作用缓和且对胎儿无不良影响；蒽醌类泻药和蓖麻油（A错）可能有致畸或诱发子宫收缩的风险，应避免使用；硫酸镁（C错）溶液适用于功能性便秘患者，肠道出血及孕妇禁用；普芦卡必利（D错）用于治疗成年女性患者中通过轻泻剂难以充分缓解的慢性便秘症状，不建议在妊娠期间，哺乳期使用本品；利那洛肽（E错）用于成人便秘型肠易激综合征（IBS-C），不建议在妊娠期间使用。